某男，50岁。患十二指肠溃疡疼痛，时见柏油样便，近日又见胃酸过多，宜选用的成药是
A. 槐角丸
B. 三七片
C. 丹七片
D. 元胡止痛片
E. 止血定痛片

正确答案：E。止血定痛片

解析：本题考查的是止血定痛片的主治。患十二指肠溃疡疼痛，时见柏油样便，近日又见胃酸过多，宜选用的成药是止血定痛片（E对）。止血定痛片：【主治】十二指肠溃疡疼痛、出血，胃酸过多。槐角丸（A错）：【主治】血热所致的肠风便血、痔疮肿痛。三七片（B错）：【主治】出血兼瘀血证，症见咯血、吐血、衄血、便血、崩漏、外伤出血、胸腹刺痛、跌仆肿痛。丹七片（C错）：【主治】瘀血痹阻所致的胸痹心痛、眩晕头痛、经期腹痛。元胡止痛片（D错）：【主治】气滞血瘀所致的胃痛、胁痛、头痛及痛经。